男，32岁。胸骨左缘第3、4肋间可闻及舒张期叹气样杂音，向心尖部传导。该患者典型临床表现还应该包括
A. 脉压增大
B. 肝颈静脉回流征阳性
C. 夜间阵发性呼吸困难
D. 劳累性呼吸困难
E. 心尖搏动呈抬举性

正确答案：A。脉压增大

解析：患者中年男性，胸骨左缘第3、4肋间可闻及舒张期叹气样杂音向心尖部传导，考虑诊断为主动脉瓣关闭不全。主动脉瓣关闭不全时，舒张期左心室一方面要接受左心房的血液，另一方面要接受从主动脉逆流过来的血液，因此左心室收缩期血量增加，收缩压增高；收缩后，主动脉的血流可部分反流至左心室，血管内血量减少，导致舒张压降低，因此主动脉瓣关闭不全患者的典型临床表现还应该包括脉压增大（A对）。肝颈静脉回流征阳性（B错）是指当右心衰竭引起肝淤血肿大时用手压迫肿大肝脏可使颈静脉怒张更明显。其发生机制是因压迫淤血的肝脏使回心血量增加，已充血右心房不能接受回心血液而使颈静脉压被迫上升所致，多见于右心衰竭。夜间阵发性呼吸困难（C错）和劳累性呼吸困难（D错）为左心衰竭的临床表现。心尖搏动呈抬举性（E错）为左心室肥厚的体征，多见于二尖瓣关闭不全，主动脉瓣狭窄等。